急性白血病骨髓移植治疗，哪项是错误的
A. 应采用HLA匹配的同胞异基因骨髓
B. 应在第一次化疗缓解后进行
C. 应及早进行，与年龄性别无关
D. 可选择自体干细胞移植
E. 异基因骨髓移植可能治愈急性白血病

正确答案：C。应及早进行，与年龄性别无关

解析：骨髓移植是急性白血病重要的治疗方法，包括自体骨髓移植（D对）和异基因骨髓移植。无论何种骨髓移植均应在第一次缓解后进行（B对），从完全缓解到自身骨髓移植的间隔时间以6个月以上为佳，年龄应控制在50岁以内（C错，为本题正确答案）；异基因骨髓移植应采用HLA匹配的同胞异基因骨髓（A对），可能治愈急性白血病（E对）；自体干细胞移植较自体骨髓移植有植入机率高，造血和免疫功能重建快的特点。